最容易刺激机体产生抗体的物质是
A. 寡糖
B. 蛋白质
C. 单糖
D. 核苷酸
E. 脂类

正确答案：B。蛋白质

解析：抗原刺激机体B淋巴细胞，使机体产生抗体。抗原本身的化学属性决定了其免疫原性，天然抗原多为大分子有机物和蛋白质（B对），免疫原性较强，最容易刺激机体产生抗体；脂类（E错）和哺乳动物的细胞核成分如核苷酸（D错）、组蛋白等通常无免疫原性，但肿瘤细胞、免疫细胞因过度活化发生凋亡后，其释放的核酸和组蛋白可能发生化学修饰或构象变化从而具备免疫原性，成为自身抗原，可诱导机体产生自身抗体。分子量和分子结构对抗原的免疫原性也有一定的影响，分子量越大，结构越复杂，其免疫原性越强，寡糖（A错）、单糖（C错）都具有免疫原性，但是不如蛋白质的明显。